对PYLL（潜在减寿年数）的表述正确的是
A. PYLL的大小与目标生存年龄的选择有关
B. PYLL能够反映减少老年人的死亡后获得的生存年数
C. PYLL间接反映死亡对寿命影响的实际水平
D. PYLL可以衡量全死因对人群的危害程度
E. PYLL指标计算容易，但不具有可加性

正确答案：A。PYLL的大小与目标生存年龄的选择有关

解析：本题考查PYLL（潜在减寿年数）的相关内容。PYLL是指某一人群在一定时期内（通常为1年）在目标生存年龄（通常为70岁或出生期望寿命）以内死亡所造成的寿命减少的总人年数。PYLL的大小与目标生存年龄的选择有关（A对BCDE错）。